有关维生素B₁的性质，正确叙述的有
A. 固态时不稳定
B. 碱性溶液中很快分解
C. 是一个酸性药物
D. 可被空气氧化
E. 体内易被硫胺酶破坏

正确答案：B、D、E。碱性溶液中很快分解；可被空气氧化；体内易被硫胺酶破坏